六腑中“主津”的是
A. 胆
B. 胃
C. 小肠
D. 大肠
E. 膀胱

正确答案：D。大肠

解析：大肠主要有传化糟粕和主津的生理机能。大肠主津，大肠接受由小肠下传的含有大量水液的食物残渣，将其中的水液吸收，使之形成粪便。即所谓燥化作用。大肠吸收水液，参与体内的水液代谢，故说：“大肠主津”大肠主津机能失常，则大肠中的水液不得吸收，水与糟粕俱下，可出现肠鸣、腹痛、泄泻等症；若大肠实热，消烁津液，或大肠津亏，肠道失润，又会导致大便秘结不通（D对）。胆主决断（A错）。胃主受纳和腐熟水谷（B错）。小肠主液（C错）。膀胱之气主通降（E错）。